腹部手术后多采取
A. 平卧位
B. 侧卧位
C. 俯卧位
D. 高坡卧位
E. 低半坐位

正确答案：E。低半坐位

解析：腹部手术后，多采取低半坐位卧式（E对）或斜坡卧位，以减少腹壁张力，防止刀口裂开。平卧位（A错）见于全麻未清醒、蛛网膜下腔麻醉后；侧卧位（B错）多见于肥胖病人，有利于呼吸和静脉回流；俯卧位（C错）为脊柱或臀部手术后应采取的体位；高坡卧位（D错）为颈、胸手术后应采取的体位。